女性，16岁，左下后牙遇冷水痛2周，平时无不适；查左下第一恒磨牙咬合面龋洞深，叩痛（-），冷水入洞痛，冷测结果同对照牙。该患牙诊断是
A. 中龋
B. 深龋
C. 慢性牙髓炎
D. 急性牙髓炎
E. 可复性牙髓炎

正确答案：B。深龋

解析：患牙深龋洞，叩痛（-），冷水入洞痛但冷测结果同对照牙，提示尚未出现任何牙髓炎症状，患牙诊断是深龋。掌握“龋病的临床表现与分类”知识点。